由原体在细胞内空泡中发育而成，经吉姆萨染色或马氏染色均呈蓝色，不具感染性，二分裂繁殖的是
A. 原体
B. 始体
C. 内基小体
D. 革兰阳性圆形体
E. 革兰阴性圆形体

正确答案：B。始体

解析：始体（又称网状体），无细胞壁，大而疏松，由原体在细胞内空泡中发育而成，经吉姆萨（Giemsa）染色或马（Macchiavello）氏染色均呈蓝色，不具感染性，为繁殖体形式，以二分裂繁殖，产生新的原体。掌握“衣原体”知识点。